某小儿因误服大量苦杏仁出现严重中毒反应，其临床表现主要是
A. 腹痛腹泻，恶心呕吐
B. 呼吸麻痹，瞳孔散大
C. 牙关紧闭，四肢抽搐
D. 面色苍白，瞳孔缩小
E. 胸闷气短，心率减慢

正确答案：B。呼吸麻痹，瞳孔散大

解析：本题考查的是中药饮片的不良反应。某小儿因误服大量苦杏仁出现严重中毒反应，其临床表现主要是呼吸麻痹，瞳孔散大（B对）。苦杏仁的不良反应表现：苦杏仁的主要成分苦杏仁苷是其有效成分也是中毒成分，误服过量苦杏仁可发生氢氰酸中毒，使延髓等生命中枢先抑制后麻痹，并抑制细胞色素氧化酶的活性而引起组织窒息。临床表现为眩晕、心悸、恶心、呕吐等中毒反应，重者出现昏迷、惊厥、瞳孔散大、对光反应消失，最后因呼吸麻痹而死亡。腹痛腹泻，恶心呕吐（A错）为误服大量雷公藤的临床表现。雷公藤的不良反应表现：①消化系统：腹痛、腹泻，恶心、呕吐，食欲不振，肝损害，少数可致伪膜性肠炎，严重者可致消化道出血。②血液系统：血小板、白细胞、血红蛋白减少，严重者可发生急性粒细胞减少、再生障碍性贫血等。③生殖系统：对男性患者雷公藤可抑制精细胞中酶的活性，导致精子产生和成熟发生障碍，表现为精子数量显著减少，长期用药还会导致性欲减退、睾丸萎缩；对女性患者雷公藤可抑制其卵巢功能，表现为月经紊乱、经量减少、卵巢早衰。④神经系统：头晕、乏力、失眠、听力减退、嗜睡、复视，还可引起周围神经炎。⑤泌尿系统：主要表现为急性肾功能衰竭，服药后迅速出现或逐渐发生少尿、水肿、血尿、蛋白尿、管型尿、腰痛或伴肾区叩击痛，常常发生于过量中毒时。⑥心血管系统：心悸、胸闷、心动过缓、气短、心律失常、心电图改变（ST-T改变），严重者可见血压急剧下降，个别出现室颤、心源性休克而死亡。⑦皮肤黏膜损害：皮肤糜烂、溃疡、斑丘疹、荨麻疹、瘙痒等。牙关紧闭，四肢抽搐（C错）为误服大量细辛的临床表现。细辛的不良反应表现：细辛中的挥发油直接作用于中枢神经系统，最终可因呼吸中枢完全麻痹而致死。细辛的急性毒性对小鼠肺、肝、肾等重要脏器均有明显损害，其中对肺脏的病理损害最为严重。细辛中毒时，常可出现头痛、呕吐、出汗、口渴、烦躁不安、面赤、呼吸急促、脉数、瞳孔散大，体温血压均升高；个别出现心慌、气短、胸闷，动则加重，窦性心动过速及双下肢水肿等急性心力衰竭症状，或精神紧张，失眠，胆小易惊，心悸、濒死感，面色萎黄灰暗，多发性阵发性窦性心动过速等心律失常伴自主神经紊乱等。严重者可出现牙关紧闭、角弓反张、意识不清、四肢抽搐、尿闭，最后因呼吸麻痹而死亡。面色苍白，瞳孔缩小（D错）为误服大量罂粟壳的临床表现。罂粟壳的不良反应表现：罂粟壳中含有的主要成分是吗啡、可待因、罂粟碱等，罂粟壳中毒与其所含的主要成分吗啡有关。其临床表现为昏睡或昏迷，抽搐，呼吸浅表而不规则，恶心、呕吐、腹泻，面色苍白，发绀、瞳孔极度缩小呈针尖样，血压下降等。目前文献报道的病例报告中，罂粟碱中毒均体现在婴幼儿中，可能因为婴儿中枢神经系统、肝、肾、酶系统等发育未成熟，对中药较敏感，易引起中毒。临床表现为胸闷气短，心率减慢（E错）的中药，2022年考试指南未明确说明。